患者男，58岁，症见心悸气促，动则尤甚，头晕，神疲乏力，咳喘，颧颊暗红，唇甲紫暗，夜寐不安，舌青紫，脉结。其治法是
A. 健脾化湿，豁痰通络
B. 健脾益气，益肺平喘
C. 补益心气，活血化瘀
D. 温补心阳，化痰宽胸
E. 温阳利水，活血化瘀

正确答案：C。补益心气，活血化瘀

解析：心气虚，鼓动乏力，故见心悸气促；则耗气故见动则尤甚，头晕，宗气衰少，功能减退故见神疲乏力，咳喘；血行瘀滞故见颧颊暗红，唇甲紫暗，夜寐不安，舌青紫，脉结（C对）。脾虚痰湿型宜健脾化湿，豁痰通络（A错）。肺脾气虚型宜健脾益气，益肺平喘（B错）。心阳不足，痰浊闭阻证宜温补心阳，化痰宽胸（D错）。阳虚水泛、瘀血内结证宜温阳利水，活血化瘀（E错）。